新生儿缺氧缺血性脑病最主要的治疗是
A. 早期运动功能训练
B. 早期维持血糖、血气、血循环正常
C. 新生儿期后的治疗
D. 早期应用脱水剂减轻脑水肿
E. 早期应用神经细胞营养药物

正确答案：B。早期维持血糖、血气、血循环正常

解析：新生儿缺氧缺血性脑病是由围生期窒息引起脑缺氧造成的相关脑损伤，脑缺氧是疾病发生发展的中心环节，治疗主要是减轻缺血缺氧，维持脑和全身良好的血流灌注，预防脑损伤和死亡，因此最主要的治疗是早期维持血糖（葡萄糖占脑组织能量氧化供能的99%，维持血糖以避免因能量不足而造成的脑水肿、凋亡肌坏死）、血气、血循环正常（B对）。早期运动功能训练（A错）是后期相关治疗。重症患者可用脱水剂减轻脑水肿（D错），一般地，防止输液过快是防治脑水肿关键措施。